不需要加热的提取方法是
A. 煎煮法
B. 连续回流提取法
C. 水蒸气蒸馏法
D. 渗漉法
E. 分馏法

正确答案：D。渗漉法

解析：本题考查中药有效成分的提取方法。不需要加热的提取方法是渗漉法（D对）。渗漉法：渗漉法是将中药粉末先装入渗漉器中用提取溶剂浸渍数小时，然后不断添加新溶剂，使其自上而下通过药物，从渗漉器下部流出，收集流出液（渗漉液）。由于在进行过程中一直保持浓度差，因此除了具有浸渍法不用加热的优点外，还具有提取效率高的特点。煎煮法（A错）：此法以水为提取溶剂，将中药粗粉加水加热煮沸提取，是最传统、经典的提取方法。连续回流提取法（B错）：此法是回流提取法的发展，具有溶剂消耗量小、操作较简便、提取效率高的特点。在实验室连续回流提取常采用索氏提取器或连续回流装置。水蒸气蒸馏法（C错）：用于提取能随水蒸气蒸馏而不被破坏的难溶于水的成分。分馏法（E错）：分馏法是利用液体混合物中各成分的沸点不同而进行分离的方法，通常分为常压分馏、减压分馏、分子蒸馏等，主要用于中药中挥发油和一些液体生物碱的分离。